可侵入翼腭窝而引起张口困难
A. 肿瘤发生自上颌窦下壁
B. 肿瘤发生自上颌窦内壁
C. 肿瘤发生自上颌窦后壁
D. 肿瘤发生自上颌窦上壁
E. 肿瘤发生自上颌窦外壁上颌窦癌根据肿瘤发生的部位，临床上可出现不同的症状

正确答案：C。肿瘤发生自上颌窦后壁

解析：肿瘤发生自上颌窦后壁时，可侵入翼腭窝而引起张口困难。掌握“中央性颌骨癌及上颌窦癌”知识点。